女性，30岁，4小时前跌伤后昏迷5分钟，清醒后步行回家。1小时前因剧烈头痛，呕吐3次送来急诊。查体：昏迷，P64次/分，BP180/90mmHg，R18次份，左瞳3mm，右瞳2mm，右上下肢肌力Ⅲ级。应立即采取的急救措施是
A. 应用促苏醒剂
B. 应用降血压药
C. 亚低温治疗
D. 严密观察病情变化
E. 静滴甘露醇，同时作开颅准备

正确答案：E。静滴甘露醇，同时作开颅准备

解析：对于急性硬膜外血肿合并脑疝的患者，应采用20%的甘露醇快速静滴以降低颅内压，同时准备行开颅手术（E对），清除血肿，妥善止血。患者昏迷主要是由脑疝、脑缺血缺氧引起，应用促苏醒药物（A错）意义不大。患者颅内压增高，脑血流量减少，应用降血压药（B错）会进一步降低脑灌注压，加剧脑缺血、缺氧。亚低温治疗（C错）可以降低脑代谢，减少缺血缺氧造成的脑组织损害，多用于脑挫裂伤的辅助治疗，但不是急救措施。严密观察病情变化（D错）为该患者的一般治疗，不是急救措施。